有关内分泌腺特点的描述，错误的是
A. 内分泌腺没有排泄管，又称无管腺
B. 内分泌腺分泌的物质称激素
C. 激素直接进人血液或淋巴
D. 内分泌腺一般体积较小，分泌的激素量亦很小,对机体无重要作用
E. 无

正确答案：D。内分泌腺一般体积较小，分泌的激素量亦很小,对机体无重要作用

解析：内分泌腺没有排泄管，又称无管腺（A对），分泌的物质称为激素（B对）。激素直接进入血液或淋巴（C对），作用于特定的靶器官。虽然内分泌腺体积较小，分泌的激素量亦很小, 但对机体有重要作用。激素直接进入血液循环，作用于特定的靶器官，与神经系统相辅相成，共同维持机体内环境的平衡与稳定，调节机体的生长发育和各种代谢活动，并调控生殖，影响各种行为（D错，为本题正确答案）。